关于NK细胞正确的叙述是
A. 发现具有特异性抗原识别受体
B. 具有MHC的限制性
C. 具有ADCC效应
D. 分泌IL-10
E. 具有抗体产生作用

正确答案：C。具有ADCC效应